有关外耳道错误的是
A. 是外耳门至鼓膜的管道
B. 外1/3为软骨部，内2/3为骨部
C. 为一弯曲管道，故作外耳道检查时，向后下方牵拉耳廓可使外耳道变直
D. 婴儿外耳道短而直，鼓膜位置近水平位
E. 无

正确答案：C。为一弯曲管道，故作外耳道检查时，向后下方牵拉耳廓可使外耳道变直

解析：外耳门至鼓膜的管道外耳道（A对) 。外耳道外1/3为软骨部，内 2/ 1为骨性部（B对) 。外耳道为一弯曲管道，只有做鼓膜检查时（C错，为本题正确答案），才需向后下方牵拉耳廓可使外耳道变直。婴儿因颞骨尚未骨化，其外耳道几乎全由软骨支持，短而直，鼓膜近于水平位（D对）。